翻花疮命名的依据是
A. 部位
B. 症状
C. 形态
D. 疾病特征
E. 范围大小

正确答案：B。症状

解析：本题考查疾病的命名原则。翻花疮一种皮肤肿瘤，以其病损部位溃破之后，不能愈合，胬肉突出，疮口外翻，好似花蕊一般，头大根小，一旦碰伤，流血不止而命名，故是以症状命名（B对）。